实行市场调节价的药品
A. 由经营者自主定价
B. 由行业协会定价
C. 由省级政府物价部门定价
D. 由省级药品监督管理部门定价
E. 由国务院物价部门制定指导价

正确答案：A。由经营者自主定价